下述哪一项不是判断乳牙接近替换期的表现
A. 牙冠破坏大
B. 临床Ⅲ°松动
C. 恒牙胚牙根已形成一半
D. 恒牙胚位置已接近乳牙根分叉
E. 乳牙根吸收已达1/2

正确答案：A。牙冠破坏大

解析：本题考查乳牙接近替换期的表现。恒牙替换乳牙从牙根处开始吸收，牙根会吸收破坏，不会破坏牙冠（A错，为本题的正确答案）。乳牙接近替换期，牙根已大部分吸收，临床Ⅲ°松动（B对）。乳牙牙根被恒牙吸收破坏，牙根吸收已达1/2（E对）。此时恒牙胚牙根已形成一半（C对），位置已接近乳牙根分叉区（D对）。